对男性尿道球部的描述，何者错误
A. 是尿道通过尿道球内之部分
B. 是尿道海绵体后端膨大之部分
C. 此部尿道较窄
D. 尿道球腺导管开口于此
E. 此部尿道破裂后，尿液可外渗至腹前壁下部

正确答案：C。此部尿道较窄

解析：尿道海绵体尿道球内的尿道最宽处（C错，为本题正确答案）为尿道球部。